卵巢动静脉通过的韧带是
A. 圆韧带
B. 主韧带
C. 宫骶韧带
D. 阔韧带
E. 骨盆漏斗韧带

正确答案：E。骨盆漏斗韧带

解析：卵巢动静脉通过的韧带是骨盆漏斗韧带（E对）。骨盆漏斗韧带起自小骨盆侧缘，向内下至卵巢的上端，韧带内有卵巢动静脉穿行，它是术中寻找卵巢动静脉的标志。圆韧带（A错）、主韧带（B错）、宫骶韧带（C错）都是固定子宫的韧带，其内无血管通过。阔韧带（D错）基底部有子宫动静脉和输尿管穿过。